奇经八脉中既称“血海”又称“经脉之海”的是
A. 冲脉
B. 任脉
C. 督脉
D. 带脉
E. 阳维脉

正确答案：A。冲脉

解析：冲脉（A对）可涵蓄调节十二经气血，为：“十二经脉之海”，又为“血海”；任脉（B错）为“阴脉之海”；督脉（C错）为“阳脉之海”；带脉（D错）约束纵行的数条经脉；阳维脉（E错）维系全身阳经。